可抑制胃蠕动及排空，延长某些药物在胃内滞留时间的中药是
A. 玫瑰花
B. 旋覆花
C. 金银花
D. 合欢花
E. 洋金花

正确答案：E。洋金花

解析：本题考查的是中西药联用在药动学上的相互作用可抑制胃蠕动及排空，延长某些药物在胃内滞留时间的中药是洋金花（E对）。中西药联用影响药物在胃肠道的稳定：药物之间通过直接改变胃肠道的内环境，比如酸碱度、胃肠蠕动和排空速率等，间接引起药物吸收情况改变。如胃宁散（麦芽、龙胆、碳酸氢钠、三硅酸镁等）、复方陈香胃片（陈皮、木香、石菖蒲、大黄、碳酸氢钠、氢氧化铝等）、活胃胶囊（砂仁、小茴香、肉桂、红曲、大黄、滑石粉、碳酸氢钠、碳酸镁等）能够改变胃液酸碱度，减少弱酸性药物阿司匹林、头孢霉素的吸收，降低疗效。一些含生物碱的中药如麻黄、颠茄、洋金花、曼陀罗、莨菪等，可抑制胃蠕动及排空，延长红霉素、洋地黄类药物在胃内的滞留时间，或使红霉素被胃酸破坏而降低疗效，或使洋地黄类药物在胃肠道内的吸收增加，引起中毒。中成药中含有某些重金属或金属离子，当与一些具有还原性的西药配伍使用时，会生成不溶性螯合物，影响药物在胃肠道的稳定性，甚至造成毒副反应。四环素类抗生素是多羟基氢化并苯衍生物，在与含金属离子如Ca²⁺、Fe²⁺、Fe³⁺、Al³⁺、Mg²⁺等的中药如石膏、海螵蛸、自然铜、赤石脂、滑石、明矾等以及含有以上成分的中成药，如牛黄解毒片等同服时，酰胺基和多个酚羟基能与上述金属离子发生螯合反应，形成溶解度小、不易被胃肠道吸收的金属螯合物，从而降低四环素在胃肠道的吸收。因此，含有上述中药成分的中成药都不宜与红霉素、洋地黄类药物同时口服。